男，36岁，平素体健。淋雨后发热，咳嗽2天，右上腹痛伴气急恶心1天。体检应注意有无
A. 右上腹肌紧张
B. 上腹部压痛
C. 肺肝界
D. 肺部呼吸音
E. 肠鸣音

正确答案：D。肺部呼吸音

解析：患者为青中年男性（为肺炎链球菌肺炎的好发年龄），平素体健，淋雨后发热（肺炎链球菌肺炎发病前常有受凉、淋雨史），咳嗽，右上腹痛伴气急恶心，根据其临床表现和体征，考虑诊断为肺炎链球菌肺炎，体检应注意有无肺部呼吸音减低（D对）（因为肺炎链球菌肺炎时，肺部呼吸音常减低）。重症患者可出现上腹部压痛（B错），多与炎症累及膈胸膜有关。右上腹肌紧张（A错）见于急性腹膜炎等疾病。肝肺境界（C错）异常见于肺气肿、肝脏等疾病。肠鸣音（E错）主要用于消化系统的诊断，其亢进主要见于肠梗阻性疾病。